不是急性牙髓炎的临床诊断要点
A. 温度测验敏感
B. 典型的疼痛症状
C. 可查到引起牙髓炎的病因
D. 牙髓活力测验值低
E. 明显叩痛

正确答案：E。明显叩痛

解析：急性牙髓炎的临床诊断要点如下：①剧烈的自发性疼痛，阵发性发作，遇冷、热刺激及夜间疼痛加重，疼痛为放散性，不能明确指出患牙。②患牙有深龋洞或有近髓、穿髓的非龋性磨耗或缺损或有深牙周袋。③温度测试可引起疼痛或疼痛加重。④晚期化脓时有搏动性跳痛，热使疼痛加剧，冷使疼痛缓解。明显叩痛是根尖炎的症状。掌握“可复性、急慢性牙髓炎”知识点。